硬脑膜
A. 与蛛网膜相续
B. 由两层合成
C. 形成齿状韧带
D. 由疏松结缔组织构成
E. 与所有颅骨连接疏松

正确答案：B。由两层合成

解析：硬脑膜是厚而坚韧的双层膜（B对）。外层为颅骨内面的骨膜，其与颅盖骨连接疏松，易于分离；在颅底处硬脑膜则与颅骨结合紧密（E错）。齿状韧带由软脊膜（C错）在脊神经前、后根之间形成。